关于基因突变的碱基置换，下述哪一项描述是错误的
A. DNA的嘌呤换成另一嘌呤，称为转换
B. DNA的嘌呤换成另一嘧啶，称为颠换
C. DNA的嘧啶换成另一嘌呤，称为转换
D. DNA的嘧啶换成另一嘧啶，称为转换

正确答案：C。DNA的嘧啶换成另一嘌呤，称为转换

解析：本题考查基因突变的碱基置换。碱基置换是指DNA多核苷酸链上某个碱基被另一种碱基取代，导致DNA碱基序列的异常。包括转换和颠换两种情况：原来的嘌呤被另一种嘌呤置换（A对）或原来的嘧啶被另一种嘧啶置换（D对），称之为转换（C错，为本题正确答案）；原来的嘌呤被嘧啶置换或原来的嘧啶被嘌呤置换，则称之为颠换（B对）。